男，40岁，烧伤后3小时入院。疼痛剧烈，感口渴。面色苍白，心率150次/min，BP85/65mmHg，头颈部、躯干部布满大小不等水疱，可见潮红创面。两上肢呈焦黄色，无水疱。其中Ⅲ度创面的处理原则是
A. 休克期常规切痂
B. 开始补液后2小时内切痂
C. 休克期过后半个月内切痂
D. 争取复苏平稳，据情尽早切痂
E. 常规分次切痂

正确答案：D。争取复苏平稳，据情尽早切痂

解析：烧伤后2～3小时渗出最为急剧，8小时达高峰，至48小时逐渐恢复。因此大面积烧伤的病人48小时内应重点抢救休克，争取平稳体液复苏，不能进行切痂手术（ABE错）。Ⅲ°烧伤后组织由开始的凝固性坏死经液化到与健康组织分离，需要2～3周，在这一过程中，随时都有发生侵入性感染的危险，为此应在争取复苏平稳后，根据病情尽早切痂（D对），而不是休克期过后半个月内切痂（C错）。